一份粉尘样品分散度测定结果如下：粉尘粒径（μm）＜2占35%；2～5占45%；5～10占15%；≥10占5%；其中呼吸性粉尘占
A. 35%
B. 45%
C. 15%
D. 80%
E. 95%

正确答案：D。80%

解析：呼吸性粉尘指粒径在5μm以下的能进入人体肺泡区的颗粒物。题中粉尘分散度测定结果中，粉尘粒径小于5μm的呼吸性粉尘占的比例为35%+45%=80%（D对）。